男，18岁，学生。咳嗽、发热1月余，多为干咳，下午3时发热，体温38.0℃，可自行退热，无咯血。发病以来体重下降3kg。胸部X线片：右肺门处可见密度增高的团块影。“青霉素”治疗半月未见好转。查体：T37.3℃，消瘦，双肺未闻及干湿啰音。该患者最可能的诊断是
A. 结节病
B. 肺门淋巴结结核
C. 右肺脓肿
D. 肺部真菌感染
E. 淋巴瘤

正确答案：B。肺门淋巴结结核

解析：患者为青少年男性，咳嗽发热1月，消瘦、低热（为肺结核的典型临床表现）、体重下降，且“青霉素”治疗无效（青霉素对肺结核无效），根据其临床表现和体征，高度怀疑肺结核，胸部X线片示右肺门处可见密度增高的团块影，故最可能诊断为肺门淋巴结结核（B对）。结节病（P94）（A错）临床表现为关节炎和结节性红斑，常伴有发热、肌肉痛，90%以上的患者表现X线胸片示双侧肺门淋巴结肿大（伴或不伴右侧气管旁淋巴结肿大）。肺脓肿（P58）（C错）多有高热，咳大量脓臭痰，胸片表现为带有液平面的空洞伴周围浓密的炎性阴影，血白细胞和中性粒细胞增高。肺部真菌感染（D错）多在应用抗生素治疗中肺炎出现或加剧，可有发热，咳嗽剧烈，痰为无色胶冻样，偶带血丝，肺部听诊可有中小水泡音，X线胸片示大片状阴影，在短期内可有变化。淋巴瘤（E错）的首发症状常是颈部或锁骨上淋巴结无痛性进行性肿大，与该患者描述不符。